老年人的心理保健不包括
A. 缩小人际交往
B. 认同老年特征
C. 适度锻炼运动
D. 增强自我意识
E. 老有所学、老有所为

正确答案：A。缩小人际交往

解析：老年人的心理保健：认同老年特征，提升自身价值；调整曲解认知，增进身心健康；加强人际交往，提高幸福指数。掌握“不同年龄阶段心理卫生”知识点。